下列属于眼眶的骨性特点的是
A. 眶缘骨质粗大
B. 强度高
C. 眶腔骨壁薄而易碎
D. 眶腔后部围绕视神经孔的骨质又变厚
E. 以上都是

正确答案：E。以上都是

解析：眼眶的骨性特点是：眶缘骨质粗大，强度高，而眶腔骨壁薄而易碎，眶腔后部围绕视神经孔的骨质又变厚，以保护视神经。掌握“颧骨及颧弓、眼眶骨折及骨折愈合过程”知识点。